血管外给药后，药物被吸收进入血液循环的速度和程度为
A. t1/2
B. 生物利用度
C. 表观分布容积
D. 清除率
E. 达峰时间

正确答案：B。生物利用度

解析：本题考查生物利用度。生物利用度（B对）是指药物被吸收进入血液循环的速度和程度；t1/2（A错）为消除半衰期；表观分布容积（C错）是指药物在体内达到动态平衡时，体内药量与血药浓度的比值；清除率（D错）是指单位时间从体内消除的含药血浆体积；达峰时间（E错）指单次服药后，血药浓度达到峰值的时间。